三叉神经痛患者在疼痛发作时上颌的痛性抽搐不包括
A. 痛区潮红
B. 眼结膜充血
C. 出汗流涎
D. 流泪
E. 患侧鼻腔黏液减少

正确答案：E。患侧鼻腔黏液减少

解析：三叉神经痛性抽搐：三叉神经痛发作时常常伴有颜面部表情肌的痉挛性抽搐，口角被牵向患侧。有时还可出现痛区潮红，结膜充血，流泪、出汗、流涎以及患侧鼻腔黏液增多等症状。掌握“三叉神经痛”知识点。